下列哪种物质是血液制品和输液过程的主要污染物？
A. 内毒素
B. 外毒素
C. 血细胞凝集素
D. 螺旋体
E. 疟色素

正确答案：A。内毒素

解析：内毒素（A对）是血液制品和输液过程中的主要污染物。外毒素（B错）、血细胞凝集素（C错）、螺旋体（D错）、疟色素（E错）都不是血液制品和输液过程的主要污染物。